不属于癌前病变的是
A. 黏膜白斑
B. 溃疡性结肠炎
C. 十二指肠溃疡
D. 乳腺导管上皮乳头状瘤样增生
E. 家族性腺瘤性肠息肉病

正确答案：C。十二指肠溃疡

解析：癌前病变是指存在癌变潜在可能的良性病变，常见的癌前疾病有：大肠腺瘤（如家族性腺瘤性肠息肉病）（E对）、乳腺纤维囊性病（如乳腺导管上皮乳头状瘤样增生）（D对）、慢性胃炎与肠上皮化生、慢性溃疡性结肠炎（B对）、皮肤慢性溃疡和黏膜白斑（A对）。十二指肠溃疡多见于青年人，几乎不发生癌变，不属于癌前病变（C错，为本题正确答案）。